尼可刹米用氢氧化钠试液溶解后，加热，逸出的气体为
A. 醋酸
B. 硫化氢
C. 氨
D. 二乙胺
E. 二氧化碳

正确答案：D。二乙胺